接种单位承担预防接种工作的区域是
A. 县级人民政府卫生主管部门指定的责任区域
B. 省级人民政府卫生主管部门指定的责任区域
C. 所在地的疾病预防控制机构指定的责任区域
D. 省级人民政府疾病预防控制主管部门指定的责任区域
E. 医疗机构执业许可证指定的责任区域

正确答案：A。县级人民政府卫生主管部门指定的责任区域